对于新建、改建、扩建的饮用水供水工程项目的预防性卫生监督，描述正确的是
A. 供水单位新建、改建、扩建的饮用水供水工程项目，应当符合卫生要求，选址和设计审查、竣工验收必须由建设、卫生计生主管部门参加
B. 新建、改建、扩建的城市公共饮用水供水工程项目由建设行政主管部门负责组织选址、设计审查和竣工验收，卫生计生主管部门不参加
C. 供水单位新建、改建、扩建的饮用水供水工程项目，应当符合卫生要求，选址和设计审查竣工验收必须由建设行政主管部门负责组织选址、设计审查和竣工验收、卫生计生主管部门参加
D. 新建、改建、扩建的城市公共饮用水供水工程项目应当符合卫生要求，选址和设计审查、竣工验收必须由建设、卫生计生主管部门参加
E. 所有新建、改建、扩建的供水工程项目，选址和设计审查、竣工验收必须由建设、卫生计生主管部门参加

正确答案：A。供水单位新建、改建、扩建的饮用水供水工程项目，应当符合卫生要求，选址和设计审查、竣工验收必须由建设、卫生计生主管部门参加

解析：本题考查饮用水卫生监督管理。《生活饮用水卫生监督管理办法》明确规定，供水单位新建、改建、扩建的饮用水供水工程项目，应当符合卫生要求，选址和设计审查、竣工验收必须有建设、卫生计生部门参加（A对BCDE错）。